患者，女，35岁。经常怕冷，四肢凉，得温可缓，面色白，舌淡嫩，脉沉迟无力，应属
A. 恶风
B. 恶寒
C. 畏寒
D. 寒战
E. 实寒

正确答案：C。畏寒

解析：畏寒是指患者自觉怕冷，多加衣被或近火取暖能够缓解（C对）。恶风是指患者遇风觉冷，避之可缓（A错）。恶寒是指患者自觉怕冷，多加衣被或近火取暖仍不能缓解（B错）。寒战见《素问玄机原病式·六气为病》形寒作颤抖状。体内寒盛多见此证，亦可由热郁所致。在诸热病中，疟疾“先寒后热”之寒，多表现为寒战（D错）。实寒证指正气不虚而寒邪结滞于内的病症。表现为口中和，舌苔白，四肢冷，小便清，腹痛，大便秘，脉沉弦等症（E错）。